肾被膜由内向外依次为
A. 肾筋膜、纤维囊、脂肪囊
B. 纤维囊、脂肪囊、肾筋膜
C. 肾筋膜、脂肪囊、纤维囊
D. 脂肪囊、纤维囊、肾筋膜
E. 脂肪囊、肾筋膜、纤维囊

正确答案：B。纤维囊、脂肪囊、肾筋膜

解析：肾的被膜分为三层：即由内向外依次为纤维囊、脂肪囊与肾筋膜（B对）。